关于舌系带的说法，何者不对
A. 位于舌下面中线上
B. 将舌系连于口腔底前部
C. 是肌性组织
D. 其根部两侧有舌下阜
E. 过短时可影响舌的活动，有碍发音

正确答案：C。是肌性组织

解析：舌系带位于舌下面的正中线上(A对)，将舌向下连于口腔底前部(B对)，舌系带上并无肌肉，为结缔组织(C错，为本题正确答案)，舌系带根部两侧黏膜隆起为舌下阜(D对)，舌系带过短会影响舌的活动，舌为辅助发音器官，活动受限会阻碍发音(E对)。